（122～123题共用题干）女，55岁。右乳房肿块6个月，不伴疼痛，无乳头溢液。查体：右乳外上象限可触及6cm×5cm肿块，质硬，边界不清。右腋窝可触及数个肿大淋巴结，部分融合。肿块穿刺活检确诊为乳腺癌，首选的治疗方式是
A. 保乳手术
B. 改良根治术
C. 放射治疗
D. 术前化疗
E. 靶向治疗

正确答案：D。术前化疗

解析：患者右乳房肿块6个月，查体发现右乳外上象限可触及 6cm×5cm肿块（T₃），质硬，边界不清。右腋窝可触及数个肿大淋巴结，部分融合（N₂），肿块穿刺活检确诊为乳腺癌。综合患者的临床表现和病理检查，应诊断为乳腺癌Ⅲ期（T₃N₂M₀，癌瘤长径＞5cm，同侧腋窝肿大淋巴结彼此融合，或与周围组织粘连）。术前化疗（D对）多用于局部晚期的病例，目的在于缩小肿瘤，提高手术成功率及探测肿瘤对药物的敏感性。保乳手术（A错）适用于临床Ⅰ期、Ⅱ期的病人，且患者为老年女性对外观要求低。乳腺癌改良根治术（B错）适用于临床Ⅰ期、Ⅱ期的病人，是目前常用的手术方式。放射治疗（C错）是局部治疗手段之一，是乳腺癌手术后治疗的重要组成部分。靶向治疗（E错）对HER2过度表达的患者有一定效果，常用于辅助治疗，特别是对其他化疗药物无效的病人也能有部分的疗效。